国家药品监督管理部门在对A省药品上市许可持有人甲实施飞行检查中，检查组要求A省药品检验所对甲的药品×进行检验。检验结果表明药品×的含量低于规定范围，决定对甲立案调查，并拟在药品质量公告中予以公告。该药品质量公告的最终发布单位是
A. A省药品监督管理部门
B. 国家药品监督管理部门
C. A省药品检验所
D. 中国食品药品检定研究院

正确答案：A。A省药品监督管理部门

解析：本题考查的是药品质量公告的定义。国家药品监督管理部门在对A省药品上市许可持有人甲实施飞行检查中，检查组要求A省药品检验所对甲的药品×进行检验。检验结果表明药品×的含量低于规定范围，决定对甲立案调查，并拟在药品质量公告中予以公告。该药品质量公告的最终发布单位是A省药品监督管理部门（A对）。药品质量公告的定义：药品质量公告是指由国务院和省级药品监督管理部门向公众发布的有关药品质量抽查检验结果的通告。《药品管理法》第101条规定，国务院和省、自治区、直辖市人民政府的药品监督管理部门应当定期公告药品质量抽查检验的结果；公告不当的，应当在原公告范围内予以更正。药品质量公告是药品监督管理的一项重要内容，也是药品监督管理部门的法定义务，药品抽查检验的结果应当依法向社会公告。